续断的性能特点有
A. 补而不滞
B. 苦辛行散
C. 甘温能补
D. 补中有行
E. 兼能涩敛

正确答案：A、B、C、D。补而不滞；苦辛行散；甘温能补；补中有行

解析：本题考查续断的性能特点。续断的性能特点有补而不滞（A对）、苦辛行散（B对）、甘温能补（C对）、补中有行（D对）。续断【性能特点】本品甘补微温，苦泄辛散，补中有行，补而不滞。入肝、肾经，既补肝肾，又行血脉，还续筋骨，为内科补肝肾、妇科止崩漏、伤科疗折伤之要药。椿皮【性能特点】本品苦燥寒清，涩能收敛，既入大肠经，又入胃、肝经，为燥泄与涩敛兼能之品。善清热燥湿、涩肠而止泻、止带，能凉血收敛而止血，并兼杀虫。